营养状况差是导致肺结核的
A. 充分病因
B. 必要病因
C. 两者均是
D. 两者均否

正确答案：D。两者均否

解析：本题考查充分病因和必要病因。营养状况差既不是导致肺结核的充分病因也不是必要病因（D对ABC错）。结核杆菌是导致肺结核的充分病因。